严重肺气肿时
A. 胸廓前后径与左右径的比例缩小
B. 胸廓扁平
C. 胸廓前后径与左右径的比例增大
D. 肋间隙变窄
E. 腹上角缩小

正确答案：C。胸廓前后径与左右径的比例增大

解析：桶状胸为胸廓前后径增加，有时与左右径几乎相等，甚或超过左右径（C对A错），故呈圆桶状，肋骨的斜度变小，其与脊柱的夹角常大于45°，肋间隙增宽（D错）且胸廓饱满（B错），腹上角增大（E错），且呼吸时改变不明显，常见于严重慢性阻塞性肺气肿（终末细支气管远端的气道弹性减退，过度膨胀、充气和肺容积增大或同时伴有气道壁破坏的病理状态，一般认为与支气管阻塞以及蛋白酶-抗蛋白酶失衡有关。）的患者和支气管哮喘发作时，亦可发生于老年或矮胖体型者。